按照其ISO规格尺寸，所有手动不锈钢根管切削器械的锥度为
A. 0.01
B. 0.02
C. 0.03
D. 0.04
E. 0.05

正确答案：B。0.02

解析：按照其ISO规格尺寸的锥度：所有手动不锈钢器根管切削械刃部的锥度为0.02，即长度每增加1mm直径增加0.02mm；D2（刃部末端直径）一律比其D1大0.32mm。掌握“髓腔进入与初预备”知识点。